对绿脓杆菌杀灭作用很强，可用于严重感染的药物是
A. 羟氨苄青霉素
B. 氯霉素
C. 头孢他啶
D. 克拉维酸
E. 红霉素

正确答案：C。头孢他啶

解析：本题考查头孢他啶。头孢他啶（C对）等第三代头孢菌素对革兰阳性菌虽有一定的抗菌作用，但较一、二代弱，对革兰阴性菌包括肠杆菌、铜绿假单胞菌及厌氧菌均有较强的抗菌活性，用于严重感染。羟氨苄青霉素（A错）又名阿莫西林，抗菌谱广，主要作用于对青霉素敏感的革兰阳性菌以及部分革兰阴性杆菌如大肠埃希菌、奇异变形杆菌、沙门菌属、志贺菌属和流感嗜热杆菌等，对绿脓杆菌无效。氯霉素（B错）的抗菌机制是抑制细菌蛋白质的合成，导致细菌死亡，用于严重感染、脑膜炎及伤寒的治疗，典型不良反应为骨髓造血功能抑制，如再生障碍性贫血、溶血性贫血等。克拉维酸（D错）作为β-内酰胺酶抑制剂，可保护不耐酶的抗菌药物结构免受破坏提高抗菌活性和效果，在临床抗感染治疗中发挥作用。红霉素（E错）为大环内酯类，其通过抑制细菌蛋白质的合成而杀灭细菌，主要用于治疗青霉素过敏患者的替代用药、军团菌病、肺炎支原体肺炎等。